有机磷农药生产或使用过程中，导致人体中毒的主要吸收途径是
A. 消化道
B. 皮肤
C. 粘膜
D. 呼吸道
E. 以上都不是

正确答案：B。皮肤

解析：有机磷农药在生产及使用过程中多由于药液不慎漏出污染皮肤（B对）导致中毒，经消化道（A错）吸收导致中毒为生活中毒的主要原因（P883）。粘膜（C错）及呼吸道（D错）非有机磷农药中毒的常见原因。